政府办基层医疗卫生机构、二级公立医院、三级公立医院基本药物配备品种数量占比原则上分别为
A. 90%，70%，50%
B. 90%，80%，60%
C. 80%，70%，60%
D. 80%，70%，50%

正确答案：B。90%，80%，60%

解析：本题考查国家基本药物的配备使用。通过加强用药监管和考核、指导督促医疗机构优化用药目录和药品处方集等措施，促进基本药物优先配备使用，提升基本药物使用占比，并及时调整国家基本药物目录，逐步实现政府办基层医疗卫生机构、二级公立医院、三级公立医院基本药物配备品种数量占比原则上分别不低于90%、80%、60%（B对）。